在急性胰腺炎发病机制中，与胰腺组织坏死和溶血关系密切的酶是
A. 脂肪酶
B. 磷脂酶A₂
C. 弹力蛋白酶
D. 糜蛋白酶
E. 胰蛋白酶

正确答案：B。磷脂酶A₂

解析：急性胰腺炎是在各种致病因素作用下，胰酶系统被提前活化，胰腺组织自身被消化所致的胰腺水肿、出血及坏死等炎性损伤。不同的消化酶产生不同的病理生理作用。磷脂酶A₂（B对）在胆酸参与下，分解细胞膜的磷脂，产生溶血卵磷脂和溶血脑磷脂，后者可引起胰腺组织坏死及溶血。脂肪酶（A错）主要参与胰腺及周围脂肪组织的坏死和液化。弹力蛋白酶（C错）水解血管壁的弹性纤维，致使血管破坏导致出血。糜蛋白酶（D错）和胰蛋白酶（E错）直接消化胰腺本身（八年制第二版内科学P549）。